治疗经行泄泻肾虚证，应首选
A. 补中益气汤
B. 香砂六君子汤
C. 人参养营汤
D. 参苓白术散
E. 健固汤合四神丸

正确答案：E。健固汤合四神丸

解析：补中益气汤功能补中益气，升阳举陷，主治脾虚气陷证及气虚发热证（A错）。香砂六君子汤功能益气健脾，行气化痰，主治脾胃气虚，痰阻气滞证（B错）。人参养营汤功能温补气血，安神和胃，主治气血不足偏阳虚者（C错）。参苓白术散功能健脾渗湿，为经行泄泻脾虚证的选方（D错）。经行泄泻肾虚证治宜温阳补肾，健脾止泻，方选健固汤合四神丸（E对）。